男，35岁，风湿性心脏病及感染性心内膜炎病史五年，无发热，无活动性胸闷、夜间阵发性呼吸困难、上下肢水肿。患者近期需要拔牙，应该进行的处置是
A. 无需用药，择期手术
B. 术前抗风湿治疗三个月
C. 术前三个月行瓣膜置换手术
D. 术前口服阿莫西林
E. 术前加强强心、利尿、扩血管治疗

正确答案：D。术前口服阿莫西林

解析：该患者男，35岁，有风湿性心脏病及感染性心内膜炎病史五年，无发热，无活动性胸闷、夜间阵发性呼吸困难、上下肢水肿。患者近期需要拔牙，结合患者的病史和诊断，在拔牙时需要在术前口服阿莫西林，预防感染性心内膜炎（D对ABCE错）。